明目地黄丸除明目外又能
A. 补气养血
B. 滋肾养肝
C. 滋阴益气
D. 健脾补肾
E. 补肾温阳

正确答案：B。滋肾养肝

解析：本题考查的是明目地黄丸的功能。明目地黄丸除明目外又能滋肾养肝（B对）。明目地黄丸【功能】滋肾，养肝，明目。龟鹿二仙膏【功能】温肾补精，补气养血（A错）。人参固本丸【功能】滋阴益气（C错），固本培元。固本咳喘片【功能】益气固表，健脾补肾（D错）。桂附地黄丸（胶囊）【功能】温补肾阳（E错）。